环境流行病学的研究特点为
A. 多因素弱效应特异性潜伏期长
B. 单因素强效应非特异性潜伏期短
C. 多因素强效应非特异性潜隐期
D. 单因素弱效应非特异性潜隐期
E. 多因素弱效应非特异性潜隐期

正确答案：E。多因素弱效应非特异性潜隐期

解析：本题考查环境流行病学的研究特点。环境流行病学是应用传统流行病学的方法，结合环境与人群健康关系的特点，从宏观上研究外环境因素与人群健康关系的科学。其研究特点为多因素弱效应非特异性潜隐期（E对ABCD错）。